伴随乳汁排出可能引起婴儿中毒的生产性毒物是
A. CO
B. 氯
C. 铅
D. CO₂
E. 以上都不是

正确答案：C。铅